男，26岁。因肠系膜血管缺血性疾病行小肠近全切除术后2个月，术后第2天开始接受全胃肠外营养支持治疗。现患者出现皮肤干燥、鳞状脱屑、脱发及伤口愈合延迟。其最可能的原因是营养液中缺乏
A. 维生素A
B. 电解质
C. 微量元素
D. 必需脂肪酸
E. 氨基酸

正确答案：D。必需脂肪酸

解析：青年男性患者，经小肠近全切除术后，接受全胃肠外营养支持治疗，出现皮肤干燥、鳞状脱屑、脱发及伤口愈合延迟等症状，系人体组织合成减慢，与必需脂肪酸缺乏有关（D对）。维生素A（A错）能维持正常视觉功能、促进骨骼正常生长发育，缺乏导致夜盲症、干眼症、皮肤干燥等，患者未出现视觉相关功能障碍。正常电解质含量能维持机体正常代谢、内环境稳定和各器官功能正常进行，电解质（B错）缺乏会造成电解质功能紊乱。微量元素（C错）缺乏会出现相关元素症状，但无身体组织合成障碍等症状。氨基酸（E错）缺乏造成人体营养不良，出现低蛋白血症、浮肿、贫血等症状。